下列活髓切断步骤中正确的是
A. 去腐、冲洗、然后隔湿、消毒
B. 用普通涡轮钻针快速去除冠髓
C. 肾上腺素棉球加压止血
D. 1：5FC浴后氢氧化钙盖髓
E. 氧化锌丁香油黏固粉和羧酸锌水门汀垫底后充填

正确答案：E。氧化锌丁香油黏固粉和羧酸锌水门汀垫底后充填

解析：本题考查活髓切断术的步骤。活髓切断步骤中正确的是氧化锌丁香油黏固粉和羧酸锌水门汀垫底后充填（E对）。活髓切断术即牙髓切断术，是切除炎症牙髓组织，以盖髓剂覆盖于牙髓断面，保留正常牙髓组织的方法。其步骤是应首先对患牙进行麻醉再去腐、冲洗、然后隔湿、消毒（A错）。用普通涡轮钻针快速去除冠髓（B错）会导致髓室内残留牙髓组织，应该用锐利挖匙或球钻去尽冠部牙髓组织。消毒棉球擦干窝洞，压迫止血，出血较多时，可用小棉球蘸0.1%肾上腺素液置于根管口牙髓断面但不能加压（C错），否则会使过多的肾上腺素进入牙髓而使牙髓受刺激出现剧烈疼痛。牙髓切断术是直接在牙髓断面上覆盖氢氧化钙（D错），不能用FC浴，否则会导致根部牙髓坏死。最后用氧化锌丁香油糊剂暂封窝洞，观察1～2周后，若无症状，除去大部分暂封剂，保留深层的氧化锌丁香油黏固粉，用磷酸锌粘固粉垫底，银汞或复合树脂永久性充填。若治疗后仍有自发痛、夜间痛等症状，为根髓有炎症的表现，此时不能保存活髓，应改行牙髓摘除术。活髓切断术的全过程中，无菌操作和尽量减少创伤是十分重要的。